三叉神经功能检查项目中不包括
A. 三叉神经分布区皮肤与黏膜的触、温、痛觉
B. 角膜反射
C. 腭反射
D. 希尔默试验
E. 咀嚼肌运动功能检查

正确答案：D。希尔默试验

解析：希尔默试验：亦称Schirmer试验。目的在于观察面神经膝状神经节是否受损。掌握“三叉神经痛”知识点。